下列各项，不属于亚急性重症肝炎并发症的是
A. 脑水肿
B. 消化道出血
C. 血糖增高
D. 电解质紊乱
E. 严重感染

正确答案：C。血糖增高

解析：亚急性重症肝炎的并发症包括：（1）肝性脑病：患者脑部常无明显的解剖异常，但约50%有脑水肿（A对）；（2）上消化道出血（B对）；（3）肝肾综合征：主要表现为少尿或无尿、氮质血症、电解质紊乱（D对）；（4）严重感染（E对）。而血糖增高（C错，为本题正确答案）,不属于亚急性重症肝炎的并发症